医疗卫生机构对可能造成重大社会影响的突发公共卫生事件，应当向所在地县级人民政府卫生行政主管部门报告的时限是
A. 1小时
B. 立即
C. 2小时
D. 12小时
E. 24小时

正确答案：C。2小时